关于消化性溃疡的治疗，正确的说法是
A. 需长期应用粘膜保护剂以降低溃疡复发率
B. 为降低复发率，需长期服用质子泵抑制剂
C. 只要内镜证实溃疡已经愈合，溃疡就不会复发
D. 根除幽门螺杆菌可以降低溃疡复发率
E. 有消化道出血的溃疡患者必须长期为此治疗

正确答案：D。根除幽门螺杆菌可以降低溃疡复发率

解析：消化性溃疡的治疗主要为药物治疗，易复发，需要维持治疗，即使内镜证实溃疡已经愈合，仍有可能复发（C错），根除Hp（幽门螺杆菌）可以降低溃疡复发率（D对）。消化性溃疡愈合后，大多数患者可以停药，需要长时程维持的情况有反复溃疡复发、Hp阴性及已经去除其他危险因素的患者（ABE错）。